关于药物效价强度的说法，错误的是
A. 比较效价强度时所指的等效反应一般采用50%效应量
B. 药物效价强度用于药物内在活性强弱的比较
C. 药物效价强度用于作用性质相同的药物之间的等效剂量的比较
D. 药物效价强度用于作用性质相同的药物之间的等效浓度的比较
E. 引起等效反应的相对剂量越小，效价强度越大

正确答案：B。药物效价强度用于药物内在活性强弱的比较

解析：本题考查效价强度。效能用于药物内在活性强弱的比较（B错，为本题正确答案）。效价强度是指能引起等效反应（一般采用50%效应量）（A对）的相对剂量或浓度。效价强度用于作用性质相同的药物之间的等效剂量或浓度的比较（CD对），其值越小则强度越大（E对）。